男，68岁。间断下腹痛腹泻6个月，乏力，面色苍白2个月，查体：右下腹压痛，可触及4cm×2cm，边界欠清晰的包块，质地硬，轻压痛。Hb86g/L，最可能的诊断是
A. 慢性细菌性痢疾
B. 肠结核
C. 克罗恩病
D. 慢性阑尾炎
E. 结肠癌

正确答案：E。结肠癌

解析：老年患者Hb86g/L（贫血，正常值≥120g/L）、右下腹肿块、乏力（右侧结肠癌典型症状），最可能的诊断是结肠癌（E对）。肠结核（B错）常为全身性结核的一部分，多有低热、盗汗等结核中毒症状。克罗恩病（C错）多有反复低热、腹泻病史，临床表现为腹痛、腹泻、体重下降，可见粘液血便。慢性细菌性痢疾（A错）、慢性阑尾炎（D错）无腹部包块。